颈动脉窦
A. 为位于颈内、外动脉分叉处的一结构
B. 为颈总动脉起始端的膨大部分
C. 为颈总动脉末端和颈外动脉起始处的膨大部分
D. 为颈总动脉末端和颈内动脉起始处的膨大部分
E. 为化学感受器

正确答案：D。为颈总动脉末端和颈内动脉起始处的膨大部分

解析：颈总动脉末端和颈内动脉起始处的膨大部分（D对）为颈动脉窦，为压力感受器。